不属于锁骨下动脉的直接分支是
A. 椎动脉
B. 甲状颈干
C. 甲状腺下动脉
D. 胸廓内动脉
E. 肋颈干

正确答案：C。甲状腺下动脉

解析：椎动脉（A对）、甲状颈干（B对）、胸廓内动脉（D对）、肋颈干（E对）均为锁骨下动脉的直接分支。甲状腺下动脉（C错，为本题正确答案）为甲状颈干的直接分支。